女性，35岁。皮下结节2年，1个月来癫痫发作频繁。查体：躯干、四肢、头皮下可触及多个0.5cm✕1cm大小的圆形结节，无触痛，与周围无粘连。最可能的诊断是
A. 囊虫病
B. 脑肿瘤
C. 原发性癫痫
D. 结核
E. 结缔组织病

正确答案：A。囊虫病